可导致戴上颌义齿后恶心、唾液增多的是
A. 义齿基托后缘欠密合
B. 颊侧系带处，基托缓冲不够
C. 磨光面形态不佳
D. 后牙排列偏颊侧
E. 义齿基托后缘过短

正确答案：A。义齿基托后缘欠密合

解析：本题考查戴用义齿初期易出现的问题-恶心。可导致戴上颌义齿后恶心、唾液增多的是义齿基托后缘欠密合（A对）。上颌义齿后缘伸展过长，刺激软腭，或义齿基托后缘与黏膜不密合，其间的唾液刺激黏膜，均可导致戴上颌义齿后恶心、唾液增多。颊侧系带处基托缓冲不够（B错），及义齿磨光面形态不佳（C错），会造成义齿在休息状态时固位良好，张口说话、打哈欠时脱位。后牙排列偏颊侧，会造成咬颊、咬舌（D错）。义齿基托后缘过短可造成义齿在口腔休息状态时脱落（E错）。